患儿，1个月。出生以来，口腔内反复见白屑样物，拭之不去，形体瘦弱，面白颧红，舌质嫩红。治疗应首选
A. 百合固金汤
B. 养阴清肺汤
C. 养胃增液汤
D. 麦味地黄丸
E. 六味地黄汤加肉桂

正确答案：E。六味地黄汤加肉桂

解析：患儿出生以来，口腔内反复见白屑样物，拭之不去，当属鹅口疮，其肾阴虚，虚火上浮，故见形体瘦弱，面白颧红，舌质嫩红，治宜滋阴潜阳，引火归元，方用六味地黄汤加肉桂（E对）。百合固金汤具有滋养肺肾，止咳化痰之功效。主治肺肾阴亏，虚火上炎之咳嗽（A错）。养阴清肺汤功能养阴清肺，软坚利咽，用于乳蛾之肺胃阴虚证（B错）。养胃增液汤功能滋脾养胃，用于厌食之脾胃阴虚证（C错）。麦味地黄丸功能养阴清热，补益肺肾，用于哮喘缓解期之肺肾阴虚证（D错）。